正常摸到足背动脉搏动的位置在
A. 胫骨前肌腱的内侧
B. 内踝前方
C. 长伸肌腱的内侧
D. 趾长伸肌腱的外侧
E. 伸拇长肌肌腱侧面

正确答案：E。伸拇长肌肌腱侧面

解析：足背动脉于伸肌上支持带下缘续于胫前动脉。在踝关节前方行于拇长伸肌腱和趾长伸肌腱之间，位置表浅，易于触及。正常摸到足背动脉搏动的位置在伸拇长肌肌腱侧面（E对）。